某女，70岁。患骨质疏松症，证属肝肾不足、瘀血阻络，症见腰脊疼痛、足膝酸软、乏力。宜选用的成药是
A. 天麻丸
B. 尪痹颗粒
C. 独活寄生合剂
D. 仙灵骨葆胶囊
E. 壮腰健肾口服液

正确答案：D。仙灵骨葆胶囊

解析：本题考查的是仙灵骨葆胶囊的主治。患骨质疏松症，证属肝肾不足、瘀血阻络，症见腰脊疼痛、足膝酸软、乏力。宜选用的成药是仙灵骨葆胶囊（D对）。仙灵骨葆胶囊：【主治】肝肾不足，瘀血阻络所致的骨质疏松症，症见腰脊疼痛、足膝酸软、乏力。天麻丸（A错）：【主治】风湿瘀阻、肝肾不足所致的痹病，症见肢体拘挛、手足麻木、腰腿酸痛。尪痹颗粒（B错）：【主治】肝肾不足、风湿痹阻所致的尪痹，症见肌肉、关节疼痛、局部肿大、僵硬畸形、屈伸不利、腰膝酸软、畏寒乏力；类风湿关节炎见上述证候者。独活寄生合剂（C错）：【主治】风寒湿痹阻、肝肾两亏、气血不足所致的痹病，症见腰膝冷痛、屈伸不利。壮腰健肾口服液（E错）：【主治】肾亏腰痛，风湿骨痛，症见膝软无力、小便频数。